据阴阳互根互济的原理，对于阴阳偏衰的治法有
A. 阴病治阳
B. 阴阳双补
C. 阳病治阴
D. 阳中求阴
E. 阴中求阳

正确答案：B、D、E。阴阳双补；阳中求阴；阴中求阳

解析：本题考查的是补其不足的含义和临床应用。据阴阳互根互济的原理，对于阴阳偏衰的治法有阴阳双补（B对）、阳中求阴（D对）与阴中求阳（E对）。对于阴阳偏衰，即阴液或阳气的一方虚损不足的病证，如阴虚、阳虚或阴阳两虚等，治当采用“补其不足”“虚者补之”之法。根据阴阳对立互制的理论，采用阴病治阳（A错）、阳病治阴（C错）冶法；根据阴阳互根互济的理论，采用阴中求阳、阳中求阴治法。1.阴病治阳：针对阳虚而阳不制阴，阴气偏亢的虚寒证，应采用助阳以抑阴的治法，又称为“益火之源，以消阴翳”。2.阳病治阴：针对阴虚而阴不制阳，阳气偏亢的虚热证，应采用滋阴以制阳的治法，又称为“壮水之主，以制阳光”。3.阴中求阳：在补阳时可适当配用补阴药的治法，使阳得阴助而生化无穷。4.阳中求阴：在补阴时可适当配用补阳药的治法，使阴得阳生而泉源不竭。对阴阳两虚证，则采用阴阳并补治法。但须分清主次而用，阳损及阴者，以阳虚为主，则应在补阳的基础上辅以滋阴之品；阴损及阳者，以阴虚为主，则应在滋阴的基础上辅以补阳之品。对于阴阳亡失的治疗，亡阳者，当回阳以固脱；亡阴者，当救阴以固脱。由于亡阳与亡阴二者均为极危重证候，皆与气脱病机密切相关，故治疗时都要施以峻剂补气固脱之法。